男，2岁。1个月来食欲减退、消瘦伴乏力，近2周低热、盗汗、干咳。2个月前曾患麻疹。查体：消瘦，未见瘢痕，颈部可触及数个肿大淋巴结，质硬，无明显压痛，心脏检查未见异常，右肺可闻及少许干湿啰音，肝肋下3cm，脾不大。首选的检查是
A. 淋巴结活检
B. 肺炎支原体抗体检测
C. EBV特异性抗体检测
D. 血常规
E. 胸部X线

正确答案：E。胸部X线

解析：患儿食欲减退，消瘦乏力，低热盗汗，为结核病的全身中毒症状。2个月曾患麻疹（有急性传染病史，可导致免疫力暂时降低），查体颈部有数个肿大质硬无压痛的淋巴结，肝肋下3cm，综上考虑诊断为肺结核，诊断肺结核的常规首选方法是胸部X线（E对），可以发现早期轻微的结核病变。